健康危害因素评价的主要目的在于
A. 改善人类生活环境
B. 阐明疾病的生物学病因
C. 便于疾病的早期诊断
D. 控制传染病的传播
E. 促进人们改变不良的行为生活方式

正确答案：E。促进人们改变不良的行为生活方式

解析：肖恩巴赫将健康危险因素评价定义为：运用流行病学和生命统计学提供的数据信息为个人提供个性化的死亡风险预测的技术方法，其目的在于降低健康风险，从而改善人们的不良的行为生活方式（E对）。改善人类生活环境是健康危险因素评价过程中的一个手段，不是目的（A错）。阐明疾病的生物学病因死流行病学研究的任务（B错）。有助于疾病的早期诊断的是健康筛检的展开（C错）。控制传染病的传播是发生在传染病传播之后进行的一项任务，而健康危害因素评价只是停留在研究危险因素与慢性病发病及死亡的关系层面（D错）。